患者，女，68岁，因尿失禁就诊。无尿频、尿急、发热等症状，血常规检查未见异常，尿培养检出大肠埃希菌，诊断为轻度压力性尿失禁。首选的治疗方案是
A. 选用头孢曲松抗感染治疗
B. 择期行阴道前壁修补术
C. 选用阿米卡星抗感染治疗
D. 选用左氧氟沙星抗感染治疗
E. 进行盆底功能康复训练

正确答案：E。进行盆底功能康复训练

解析：本题考查尿失禁用药。轻至中度的压力性尿失禁以非手术治疗为主，首选治疗方案为进行盆底肌功能康复训练（E对）。